描述中耳错误的是
A. 位于外耳和内耳之间
B. 为一含气空腔，大部位于颞骨岩部
C. 包括鼓室、咽鼓管、乳突窦和乳突小房
D. 有三块听小骨位于中耳鼓室内
E. 外耳道软骨部有可动性

正确答案：E。外耳道软骨部有可动性

解析：中耳由鼓室、咽鼓管、乳突窦和乳突小房组成（C对），为一含气的不规则腔道，大部分位于颞骨岩部内（B对）。中耳向外借鼓膜与外耳道相隔，向内毗邻内耳（C对）。鼓室内的听小骨有3 块（D对），即锤骨、砧骨和镫骨。外耳道软骨部有可动性所描述的不是中耳（E错，为本题正确答案）。